可导致软骨关节病损、跟腱炎症，18岁以下儿童禁用的抗菌药物是
A. 林可霉素类
B. 酰胺醇类（氯霉素）
C. 四环素类
D. 氨基糖苷类
E. 氟喹诺酮类

正确答案：E。氟喹诺酮类

解析：本题考查药物的不良反应。可导致软骨关节病损、跟腱炎症，18岁以下儿童禁用的抗菌药物是氟喹诺酮类（E对）。林可霉素类（A错）的不良反应有过敏性反应、血管神经性水肿等。酰胺醇类（B错）抗生素具有血液系统毒性，能够引起再生障碍性贫血。四环素类（C错）抗生素会与金属离子螯合，沉积于牙齿及骨骼中，导致牙齿黄染及新生儿骨骼发育不正常。氨基糖苷类（D错）不良反应为肾毒性和耳毒性。